卵巢肿瘤患者盆腔X线示牙齿及骨骼提示的肿瘤是
A. 库肯勃瘤
B. 卵泡膜细胞瘤
C. 纤维瘤
D. 颗粒细胞瘤
E. 畸胎瘤

正确答案：E。畸胎瘤

解析：卵巢肿瘤患者盆腔X线示牙齿及骨骼提示的肿瘤是畸胎瘤（E对），又称为皮样囊肿，多为单房，腔内充满油脂和毛发，有时可见牙齿或骨质。